患者女，25岁，发热，咳嗽，流涕。2周后退热，但又出现胸闷心悸，心率120次/分，心律不齐，偶闻早搏，心电图：低电压，T波低平，应首先考虑
A. 风湿性心肌炎
B. 风湿性心脏病
C. 急性心包炎
D. 病毒性心肌炎
E. 扩张型心肌病

正确答案：D。病毒性心肌炎

解析：患者女，25岁，发热，咳嗽，流涕2周后退热（病毒感染的表现），但又出现胸闷心悸（心脏受累的表现），心率120次/分，心律不齐，偶闻早搏（并发症心律失常极常见，以早搏和房室传导阻滞最为多见），心电图：低电压，T波低平（心电图为ST-T改变）（D对）。风湿性心肌炎病前1～3周有链球菌感染史或感染的其他证据，如咽拭子培养A族溶血性链球菌生长，血清溶血性链球菌抗体增高；常有心脏杂音，可有关节疼痛、环形红斑、皮下结节、舞蹈病；实验室检查血沉增快、C反应蛋白阳性；心电图P-R间期延长较常见等（A错）。风湿性心脏病患病初期常常无明显症状，后期则表现为心慌气急、乏力、咳嗽、肢体水肿、咳嗽、咯血，直至心力衰竭，引起生命危险（B错）。急性心包炎以心前区疼痛、心包摩擦音、呼吸困难和一系列心电图改变为特点（C错）。扩张型心肌病主要表现为充血性心力衰竭，一般先有左心衰，之后出现右心衰。可有各种心律失常，部分病人可发生栓塞或猝死，病死率较高。主要体征为心脏扩大，多数病人可听到第三心音或第四心音，心率快时呈奔马律，可有相对二尖瓣或三尖瓣关闭不全所致的收缩期吹风样杂音。左心衰可有交替脉、肺部啰音；右心衰有颈静脉怒张、肝肿大、浮肿等体征。常合并各种类型的心律失常（E错）。